下列各项中，哪一项不是深龋的临床表现
A. 冷热刺激痛
B. 食酸甜食物敏感
C. 自发痛
D. 食物嵌塞痛
E. 牙髓活力测试正常

正确答案：C。自发痛

解析：本题考查深龋的临床表现。自发痛（C错，为本题的正确答案）不是深龋的临床表现。深龋表现为遇冷热刺激出现酸痛（A对），食酸甜食物敏感（B对），但没有自发痛，若食物嵌入龋洞中可引起疼痛（D对），牙髓活力测验用正常对照牙（E对）。探诊时敏感，去净腐质后不露髓。